基托与唾液、唾液与黏膜间的附着力称为
A. 摩擦力
B. 吸附力
C. 表面张力
D. 大气压力
E. 重力

正确答案：B。吸附力

解析：吸附力：包括基托与唾液、唾液与黏膜间的附着力，以及唾液分子间的内聚力。掌握“局部义齿人工牙及基托”知识点。